一患者出现右眼视野鼻侧半和左眼颞侧半偏盲，可能是下述何结构损伤所致
A. 左侧视辐射或视束
B. 右侧视辐射或视束
C. 视交叉外侧部的不交叉纤维
D. 视交叉内侧部的交叉纤维
E. 无

正确答案：C。视交叉外侧部的不交叉纤维

解析：本题患者出现右眼视野鼻侧半和左眼颞侧半偏盲，符合视交叉外侧部的不交叉纤维损伤（C对）特征；一侧视束及以后的视觉传导路（视辐射、视区皮质）（AB错）受损，可致双眼病灶对侧半视野同向性偏盲；视交叉中交叉纤维（D对）损伤 可致双眼视野颞侧半偏盲。